不属于窒息的前驱症状的是
A. 安静
B. 口唇发绀
C. 鼻翼扇动
D. 出汗
E. 出现“三凹”体征

正确答案：A。安静

解析：本题考查口腔颌面部创伤急救。安静（A错，为本题正确答案）不属于窒息的前驱症状。窒息的临床表现：窒息的前驱症状为患者烦躁不安、出汗（D对）、口唇发绀（B对）、鼻翼扇动（C对）和呼吸困难、严重者在呼吸时出现“三凹”（锁骨上窝、胸骨上窝及肋间隙明显凹陷）体征（E对）；随之发生脉弱、脉速、血压下降及瞳孔散大等危象以至死亡。